微量元素与机体有害效应的关系，不正确的是
A. 必需微量元素具有两重性，摄入过量或过少都会对人体产生危害
B. 必需微量元素缺乏，可影响机体某些蛋白质的合成
C. 锌、铜、硒和锰等微量元素缺乏可影响正常生殖和生育功能
D. 某些微量元素摄入过高或过低，会引起地方病
E. 目前认为必需微量元素有24种

正确答案：E。目前认为必需微量元素有24种

解析：本题考查微量元素的相关内容。必需微量元素是指在生物体内是维持正常生理、生化功能、生长发育和生殖繁衍所必不可缺的元素，目前认为必需微量元素有14种（E错，为本题正确答案），包括锌、铁、铜、钼、铬、锰、钴、镍、锡、钒、碘、硒、氟和硅。必需微量元素具有两重性，摄入过量或过少都会对人体产生危害（A对），也会引起地方病（D对）。必需微量元素缺乏，可影响机体某些蛋白质的合成（B对）以及正常生殖和生育功能（C对）。